某男，35岁。口腔黏膜溃疡，周边红肿，灼痛明显，每因过食煎炒辛辣食物而发，并伴口渴心烦，大便秘结，小便短黄，舌红，苔黄腻，脉数有力。治宜选用的方剂是
A. 凉膈散
B. 枳术丸
C. 龙胆泻肝汤
D. 附子理中丸
E. 玉女煎

正确答案：A。凉膈散

解析：本题考查的是口疮的辨证论治。口腔黏膜溃疡，周边红肿，灼痛明显，每因过食煎炒辛辣食物而发，并伴口渴心烦，大便秘结，小便短黄，舌红，苔黄腻，脉数有力。治宜选用的方剂是凉膈散（A对）。口疮是以唇、颊、舌、上腭等处黏膜发生黄白色溃烂点且灼热疼痛为主要特征的病症。西医学的复发性阿弗他口炎、复发性口腔溃疡、复发性口疮等有上述表现者均可参考此内容辨证论治。（一）心脾积热证：【症状】口腔黏膜溃疡，灼痛明显，常因过食煎炒辛辣或少寐而发，伴口渴心烦、失眠、小溲短黄、大便秘结；检查见口腔黏膜表面有黄白色假膜，周边红肿。舌红，苔黄或腻，脉数有力。【方剂应用】基础方剂为凉膈散（大黄、朴硝、栀子、黄芩、连翘、薄荷、竹叶、甘草）加减。（二）脾肾阳虚证：【症状】口疮疼痛较轻，久难愈合，伴倦怠乏力，腰膝或少腹以下冷痛，小便清；检查见口疮色白或暗，周边淡红或不红。舌淡，苔白，脉沉迟。【方剂应用】基础方剂为附子理中丸（D错）（人参、白术、甘草、干姜、附子）合金匮肾气丸（附子、桂枝、熟地黄、山药、茯苓、山茱萸、泽泻、丹皮）加减。龙胆泻肝汤（C错）是鼻渊胆经郁热证的方剂应用。鼻渊胆经郁热证：【症状】脓涕量多，色黄或黄绿，或有臭味，鼻塞重，嗅觉差，鼻黏膜红赤。伴头痛较剧，口苦，咽干，目眩，耳鸣，耳聋，寐少梦多，烦躁易怒，小便黄赤。舌质红，舌苔黄或腻，脉弦数。【方剂应用】基础方剂为龙胆泻肝汤（龙胆、栀子、黄芩、泽泻、木通、车前子、当归、柴胡、生地黄、甘草）加减。玉女煎（E错）是消渴阴虚燥热的方剂应用。消渴阴虚燥热证：【症状】烦渴引饮，消谷善饥，小便频数而多，尿浑而黄，形体消瘦。舌红，苔薄黄，脉滑数。【方剂应用】基础方剂为玉女煎（生石膏、熟地、麦冬、知母、牛膝）加减。方剂应用为枳术丸（B错）的病证，2022年考试指南未明确说明。